关于下肢丹毒临床表现的描述，正确的是
A. 在中央部的表面有脓栓
B. 局部多呈紫红色
C. 界线清楚
D. 局部硬肿
E. 常累及双侧肢体

正确答案：C。界线清楚

解析：丹毒起病急，开始即可有畏寒、发热、头痛、全身不适等。病变多见于单侧下肢（E错），表现为片状皮肤红疹、微隆起、色鲜红（B错）、中间稍淡、境界较清楚（C对）。局部有烧灼样疼痛，病变范围向外周扩展时，中央红肿消退而转变为棕黄。有的可起水疱，附近淋巴结常肿大、有触痛，但皮肤和淋巴结少见化脓破溃。疖的临床表现为初始局部皮肤有红、肿、痛的小硬结（D错），数日后肿痛范围扩大、小硬结中央组织坏死、软化，出现黄白色的脓栓（A错），而不是丹毒。